临床急救的伦理要求是
A. 勇担风险，团结协作
B. 掌握手术指征，动机纯正
C. 以健康、稳定的情绪影响患者
D. 对症下药，剂量安全
E. 减轻痛苦，加速康复

正确答案：A。勇担风险，团结协作

解析：急诊病人具有突发性强，人群密集、病况复杂，抢救困难、病情危重，依法纠纷等特点，急诊科室是集内、外、妇、儿等专科于一体的综合科室，是所有科室工作的集合，在抢救危重病人时，只有多个科室的医务人员团结协作，才能达到最佳抢救效果；急诊科室医护人员奋战在医院的最前线，工作繁重、任务艰巨，还要不时地承担风险。临床急救的伦理要求是：勇担风险，团结协作（A对）；争分夺秒，全力以赴；常备不懈，沉着冷静；优化技能，强化功底；人性服务，呵护心理；集思广益，坚守慎独。